关于药物排泄的说法，错误的是
A. 药物可因与血浆蛋白结合不被肾小球滤过而减少排泄
B. 药物可因与血浆蛋白结合不被肾小管分泌而减少排泄
C. 尿量增加可降低尿液中药物浓度，导致重吸收减少而增加排泄
D. 经乳汁排泄的药物可能影响乳儿的安全，应予关注
E. 经胆汁排泄的药物，可因肠肝循环致作用时间延长

正确答案：B。药物可因与血浆蛋白结合不被肾小管分泌而减少排泄

解析：本题考查的是影响药物排泄的因素。血浆蛋白结合率不影响药物的肾小管分泌（B错，为本题正确答案）。排泄系指体内的药物及其代谢产物从各种途径排出体外的过程。药物及其代谢产物主要经肾排泄，其次是胆汁排泄。也可由乳汁、唾液、汗腺等途径排泄。药物的肾排泄包括肾小球滤过、肾小管重吸收和肾小管分泌。与血浆蛋白结合的药物不被肾小球滤过（A对）。药物的血浆蛋白结合率以及药物与血浆蛋白的竞争性结合等可影响药物的肾排泄。肾小管的重吸收主要与药物的脂溶性、pKₐ、尿液的pH和尿量密切相关。通常脂溶性非解离型药物的重吸收多，尿量增加可降低尿液中药物浓度，重吸收减少，排泄增加（C对）。肾小管分泌可使药物的肾排泄增加，这一过程是主动转运，有载体参与。由于载体缺乏高度特异性，一些阳离子药物之间或阴离子药物之间与载体发生的竞争抑制作用可影响药物的肾小管分泌，从而延长药物在体内的作用时间。血浆蛋白结合率不影响药物的肾小管分泌。胆汁中排泄的药物或药物代谢物，在小肠中重新吸收进入肝门静脉的现象称为肠肝循环。药物的代谢物以结合型经胆汁排泄，若在肠道中水解为原型，脂溶性增加，易被重吸收。肠肝循环的药物作用时间长。使用抑制肠道菌丛的抗生素则肠肝循环减少（E对）。